家族性息肉病首选的治疗是
A. 内镜下摘除
B. 内镜下圈套电灼切除
C. 开腹手术
D. 肛门镜下显微手术
E. 扩肛后拖出切除

正确答案：C。开腹手术

解析：家族性息肉病是癌前病变，手术是唯一有效的治疗手段。其手术治疗切除范围较大，所以是开腹手术（C对）。仅内镜下摘除息肉（A错）、内镜下圈套电灼切除（B错），不能达到根治的效果。由于需要做肠管之间的吻合或回肠造口术等，肛门镜下显微手术（D错）或扩肛后拖出切除（E错）均不能达到手术要求。